鉴别牙龈增生性疾病的主要依据如下，除外
A. 主诉及临床表现
B. 服药史
C. X线片
D. 骨髓象
E. 全身病史

正确答案：C。X线片

解析：本题考查鉴别牙龈增生性疾病的主要依据。鉴别牙龈增生性疾病的主要依据如下，除外X线片（C错，为本题的正确答案）。牙龈增生性疾病属于软组织增生性疾病，而X线片只反应骨缺损的大小和范围的影像，而不能呈现软组织的影像，故不能用X线片鉴别龈增生性疾病。牙龈增生性疾病有广泛牙龈增生的临床表现（A对），故根据主诉和临床表现即可鉴别。骨髓象（D对）是反应骨髓造血的活跃程度，当发生白血病时，骨髓增生“明显活跃”或“极度活跃”，故可用骨髓象诊断白血病引起的牙龈增生。药物性牙龈肥大有长期服药史（B对）和全身病史（E对），故根据牙龈实质增生特点、服药史、全身病史诊断本病并不困难。